影响熊去氧胆酸的吸收，不宜同时服用的药物
A. 氢氧化铝
B. 双歧杆菌三联活菌
C. 昂丹司琼
D. 利那洛肽
E. 奥美拉唑

正确答案：A。氢氧化铝

解析：本题考查药物的相互作用。影响熊去氧胆酸的吸收，不宜同时服用的药物是氢氧化铝（A对），其可以在肠中和熊去氧胆酸结合，从而阻碍后者吸收，影响疗效；双歧杆菌三联活菌（B错）主治因肠道菌群失调引起的急慢性腹泻、便秘，抗酸药、抗菌药与活菌制剂合用可减弱其疗效，避免同服；昂丹司琼（C错）通过拮抗5-羟色胺受体，抑制迷走神经兴奋导致的呕吐反射；利那洛肽（D错）用于成人便秘型肠易激综合征（IBS-C）；奥美拉唑（E错）为质子泵抑制药，不推荐与氯吡格雷联合使用。